下列中枢性镇咳药中，镇咳作用最强的药物是
A. 可待因
B. 苯丙哌林
C. 喷托维林
D. 右美沙芬
E. 福尔可定

正确答案：B。苯丙哌林

解析：本题考查苯丙哌林。选项中镇咳作用最强的药物是苯丙哌林（B对）。苯丙哌林镇咳作用较强，为可待因（A错）的2～4倍，即苯丙哌林镇咳作用强于可待因。喷托维林（C错）镇咳作用强度约为可待因的1/3，即其镇咳作用弱于可待因和苯丙哌林。右美沙芬（D错）镇咳强度与可待因相等或略强，即其镇咳作用弱于苯丙哌林。福尔可定（E错）具有与可待因相似的镇咳、镇痛作用，即其镇咳作用弱于苯丙哌林。故选项中镇咳作用最强的药物是苯丙哌林。